缝合的创口，一般在7～10天内全部愈合者，称为
A. 一期愈合
B. 二期愈合
C. 感染创口
D. 无菌创口
E. 延期愈合

正确答案：A。一期愈合

解析：缝合的创口，一般在7～10天内全部愈合者，称为初期或一期愈合。未经缝合的创口，其愈合往往经过肉芽组织增生，再为周围上皮爬行覆盖的过程，在临床上称为二期或延期愈合（拔牙创口的愈合即属此类），这种创口愈合后结缔组织多，在软组织部位，形成明显的瘢痕。掌握“口外创口处理”知识点。